女，20岁，主诉自初中毕业后，越来越不能与陌生人接触，近1年来发展为见到熟人也害怕与之说话，且一说话就脸红，对于该患者心理治疗首选的方法为
A. 生物反馈
B. 系统脱敏
C. 自由联想
D. 催眠治疗
E. 人本主义

正确答案：B。系统脱敏

解析：此题患者可以诊断为社交恐怖症，首选方法是系统脱敏疗法（B对）。治疗师帮助患者建立与不良行为反应相对抗的松弛条件反射，然后在接触引起这种行为的条件刺激中，将习得的放松状态用于抑制焦虑反应，使不良行为逐渐消退（脱敏），最终使不良行为得到矫正。生物反馈疗法（A错）对多种与社会心理应激有关的心身疾病都有较好疗效，如紧张性头痛、血管性头痛等。系统脱敏（B错）主要用于治疗恐怖症，也可用于癔症。自由联想（C错）是精神分析疗法的一种，治疗者坚持让病人说出心中所想的事情，在倾听病人的自由联想时，仔细分析并发现阻碍病人思想自由表达的障碍物，对神经症性障碍疗效较好。催眠疗法（D错）是运用暗示的方法使患者进人一种特殊的意识状态，控制患者的心身活动，从而解除和治疗患者的心身问题的心理疗法。人本主义治疗（E错）要以来访者为中心，创造一个使来访者自我发现、自我成长的环境和氛围，帮助来访者认识、理解、正视自己真实的情绪和需求，启发其潜能的释放，使之从否定自己的情绪或需求的状态转而接受自己，并依靠自身的成长、成熟战胜不良的情绪、行为。